男，29岁。尿频、尿急、尿痛伴尿道内不适1年余。近日晨起排尿终末可见尿道口“滴白”，下腹部及会阴隐痛，无寒战和高热。最可能的诊断是
A. 良性前列腺增生
B. 慢性膀胱炎
C. 急性细菌性前列腺炎
D. 慢性前列腺炎
E. 慢性尿道炎

正确答案：D。慢性前列腺炎

解析：男，29岁。尿频、尿急、尿痛伴尿道内不适1年余（尿路刺激症）。近日晨起排尿终末可见尿道口“滴白”，下腹部及会阴隐痛，无寒战和高热（前列腺炎常见症状），且病程有1年。最可能的诊断是慢性前列腺炎（D对）。良性前列腺增生（A错）主要症状包括尿频、尿急、尿失禁以及夜尿增多等。慢性膀胱炎（B错）没有“滴白”。急性细菌性前列腺炎（C错）发病突然，为急性疼痛伴随着排尿刺激症状和梗阻症状以及发热全身症状。慢性尿道炎（E错）会有尿道口红肿，尿液浑浊。